1%透明质酸钠关节腔内注射，对于改善关节症状亦有帮助。适用于哪种TMD的疾病
A. 翼外肌功能亢进
B. 翼外肌痉挛
C. 不可复性关节盘移位
D. 可复性关节盘移位
E. 肌筋膜痛

正确答案：C。不可复性关节盘移位

解析：不可复性关节盘移位的封闭治疗：对伴开口受限时间较短者使用2%普鲁卡因2ml关节腔内注射后，采用简单的手法复位即可使之开口度恢复正常，转变为可复性关节盘前移位，关节弹响出现。进而按关节盘可复性前移位进行治疗。1%透明质酸钠关节腔内注射，以改变关节腔内流变学性能，减少关节内摩擦，对于改善关节症状亦有帮助。掌握“颞下颌关节紊乱”知识点。